包被颈部脏器，如喉、气管、甲状腺、咽及食管等结构的是
A. 颈浅筋膜
B. 颈深筋膜浅层
C. 颈深筋膜中层
D. 颈脏器筋膜
E. 椎前筋膜

正确答案：D。颈脏器筋膜

解析：颈脏器筋膜：包被颈部脏器，如喉、气管、甲状腺、咽及食管等。掌握“颈部分区、颈筋膜层次及下颌下三角解剖特点”知识点。